下列有关全冠适应证说法正确的是
A. 固定义齿的固位体
B. 咬合低、邻接不良
C. 牙体恢复正常解剖外形
D. 牙体严重缺损，固位形、抗力形较差者
E. 以上说法均正确

正确答案：E。以上说法均正确

解析：本题考查牙体缺损修复体固位及适应、禁忌证。全冠适应证①牙体严重缺损，固位形、抗力形较差者（D对）。②存在咬合低、邻接不良（B对）、牙冠短小、错位牙改形、牙冠折断或半切除术后需要以修复体恢复正常解剖外形（C对）、咬合、邻接及排列关系者。③固定义齿的固位体（A对）。④活动义齿基牙的缺损需要保护、改形者。⑤龋坏率高或牙本质过敏严重伴牙体缺损，或银汞合金充填后与对颌牙、邻牙存在异种金属微电流刺激作用引起症状者。⑥后牙隐裂，牙髓活力未见异常，或者已经牙髓治疗后无症状者。因此，以上说法均正确，选E。